男性前尿道是指尿道的
A. 海绵体部
B. 球部
C. 前列腺部
D. 膜部
E. 膜部和尿道球部

正确答案：A。海绵体部

解析：男性前尿道是指尿道的海绵体部（A对）。